腺热的传播媒介是
A. 蜱
B. 人虱
C. 吸虫
D. 恙螨
E. 鼠蚤和鼠虱

正确答案：C。吸虫

解析：腺热传播媒介是吸虫。掌握“立克次氏体”知识点。